原发性肝癌最易转移的脏器是
A. 肝内
B. 肺
C. 骨
D. 脑
E. 胰腺周围和腹膜后

正确答案：A。肝内

解析：原发性肝癌最易沿着丰富的门静脉系统在肝内（A对）进行转移。血行转移可累及肺（B错）、骨（C错）和脑（D错）；淋巴转移可累及胰腺周围和腹膜后（E错），但均不是最易转移的脏器。